男性，70岁。下楼时不慎摔伤右髋部。查体：右下肢缩短，外旋50°畸形，右髋肿胀不明显，但有叩痛。该患者最可能的诊断是
A. 右髋后脱位
B. 右髋前脱位
C. 右股骨颈骨折
D. 右股骨粗隆间骨折
E. 右髋软组织损伤

正确答案：C。右股骨颈骨折

解析：老年男性患者，右髋部摔伤后，右下肢缩短、外旋50°畸形（提示可能为股骨颈骨折）、叩痛，结合患者病史、临床表现及体查结果，该患者最可能的诊断为右股骨颈骨折（C对）。髋关节后脱位（A错）时患肢缩短，呈屈曲、内收、内旋畸形。髋关节前脱位（B错）时患肢呈屈曲、外展、外旋畸形。股骨粗隆间骨折（P661）（D错）即股骨转子间骨折时，患肢极度外旋，严重者可达90°外旋。髋部软组织损伤（E错）不会有患肢缩短及外旋畸形等表现。